男，30岁。剧烈活动后突发胸痛1小时。查体：P98次/分，R25次/分，急性病容，呼吸浅快。右肺叩诊鼓音，听诊呼吸音消失，左肺呼吸音正常。最可能的诊断是
A. 胸腔积液
B. 支气管哮喘
C. 自发性气胸
D. 肺气肿
E. 肺栓塞

正确答案：C。自发性气胸

解析：患者剧烈活动后（诱因）突发胸痛，急性病容，呼吸浅快。右肺叩诊鼓音，听诊呼吸音消失，左肺呼吸音正常。最可能的诊断是自发性气胸（C对）。